关于过氧化值说法正确的是
A. 油脂中饱和脂肪酸被氧化形成过氧化物的量
B. 油脂产生的含醛基脂肪酸的量
C. 一般以100g被测油脂使碘化钾析出碘的克数表示
D. 是油脂酸败的晚期指标
E. 一般用硫代巴比妥酸法测定

正确答案：C。一般以100g被测油脂使碘化钾析出碘的克数表示

解析：本题考查过氧化值的相关内容。过氧化值是指油脂中不饱和脂肪酸被氧化形成过氧化物的量（AB错），以100g被测油脂使碘化钾析出碘的克数表示（C对）。过氧化值是一个反映油脂酸败早期状态的指标（D错）。丙二醛一般用硫代巴比妥酸法测定（E错）。